对食盐氟化评价说法错误的是
A. 费用较低
B. 每个家庭可自由选择
C. 需要设备完好的供水系统
D. 与饮水氟化相比，减少了氟的浪费
E. 覆盖人群广泛，不受地区条件限制，可大规模地生产和供应

正确答案：C。需要设备完好的供水系统

解析：食盐氟化的评价：食盐氟化的优点主要包括：①覆盖人群广泛，不受地区条件限制，可大规模地生产和供应；②不需要设备完好的供水系统；③与饮水氟化相比，减少了氟的浪费；④生产和控制方法简单，费用较低；⑤每个家庭可自由选择，无心理上的压力。掌握“氟的全身及局部应用”知识点。